气陷证可见的症状是
A. 刺痛拒按，固定不移，舌暗，脉涩
B. 气短疲乏，脘腹坠胀，舌淡，脉弱
C. 胸胁胀闷窜痛，时轻时重，脉
D. 面色淡白，口唇爪甲色淡，舌淡，脉细
E. 少气懒言，疲乏无力，自汗，舌淡，脉虚

正确答案：B。气短疲乏，脘腹坠胀，舌淡，脉弱

解析：刺痛拒按，固定不移，舌暗，脉涩是血瘀证的临床表现（A错）。气陷证是气虚无力升举，清阳之气下陷所致，是从气虚的基础上发展而来。气虚日久，清阳之气不升，脏腑机能减退，故见气短疲乏，气虚无力升举，不能维持脏气正常位置，故觉脘腹坠胀，气虚不能推动营血上荣，不能鼓动血液运行，故舌淡，脉弱（B对）。胸胁胀闷窜通，时轻时重，脉弦是气滞证的临床表现（C错）。面色淡白，口唇爪甲色淡，舌淡，脉细是血虚证的临床表现（D错）。少气懒言，疲乏无力，自汗，舌淡，脉虚是气虚证的临床表现（E错）。